下列氨基酸中不属于必需氨基酸的是
A. 缬氨酸
B. 苏氨酸
C. 赖氨酸
D. 蛋氨酸
E. 谷氨酸

正确答案：E。谷氨酸

解析：人体必需氨基酸为：苯丙氨酸，苏氨酸，色氨酸，缬氨酸，异亮氨酸，赖氨酸，亮氨酸，蛋氨酸共8种。掌握“蛋白质生理作用及消化”知识点。